可抑制血小板聚集和释放的药物是
A. 肝素
B. 华法林
C. 噻氯匹啶
D. 尿激酶
E. 维生素K

正确答案：C。噻氯匹啶

解析：本题考查噻氯匹啶。噻氯匹啶（C对）对于多种因素诱导的血小板聚集有抑制作用，能够抑制血栓的形成。肝素（A错）对凝血的各个环节均有作用。华法林（B错）为维生素K拮抗药。尿激酶（D错）是一种溶栓药。维生素K（E错）为肝脏合成凝血因子Ⅱ、Ⅶ、Ⅸ、X所必须的物质。